异位妊娠是指
A. 受精卵着床于子宫以外
B. 受精卵着床于子宫+附件以外
C. 受精卵着床于子宫体腔以外
D. 受精卵着床于腹腔以外
E. 受精卵着床于宫颈管以外

正确答案：C。受精卵着床于子宫体腔以外

解析：异位妊娠是指受精卵着床于子宫体腔以外，包括在输卵管、腹腔、阔韧带、卵巢及宫颈。所以选C。A项不包括宫颈，不选。掌握“异位妊娠”知识点。